患者发热，口渴，心烦，失眠，口舌生疮，小便短赤灼热涩痛，便秘，舌尖红，苔黄，脉数有力，其临床意义是
A. 心火亢盛证
B. 痰蒙心神证
C. 痰火扰神证
D. 肺热炽盛证
E. 风热犯肺证

正确答案：A。心火亢盛证

解析：患者心火炽盛，热扰心神，故心烦失眠；心火上炎舌窍，故见口舌生疮；心火下移小肠，故见小便短赤，灼热涩痛；热蒸于外故发热，热盛伤津故口渴，便秘；火热内盛，故舌尖红，苔黄，脉数有力；故辨证为心火亢盛证（A对）。痰蒙心神证是指痰浊内盛，蒙蔽心神，以神志抑郁、错乱、痴呆、昏迷及痰浊症状为主要表现的证（B错）。痰火扰神证是以狂躁、神昏及痰热症状为主要表现的证（C错）。肺热炽盛证是指热邪壅肺，肺失清肃，以咳嗽、气喘及里实热症状为主要表现的证（D错）。风热犯肺证是以咳嗽及风热表证症状为主要表现的证（E错）。